某地的一项关于膀胱癌与吸烟关系的大规模研究得出，吸烟者膀胱癌的发病率为50/10万，非吸烟者的膀胱癌的发病率为25/10万，根据以上资料，因吸烟所致的超额危险度（即特异危险度）为（）/10万
A. 6
B. 8
C. 25
D. 32
E. 50

正确答案：C。25